通过寡肽药物转运体（PEPT1）进行体内转运的药物是
A. 伐昔洛韦
B. 阿奇霉素
C. 特非那定
D. 酮康唑
E. 沙丁胺醇

正确答案：A。伐昔洛韦

解析：本题考查药物化学结构与生物活性。伐昔洛韦（A对）可通过寡肽药物转运体（PEPT1）进行体内转运。小肠上皮细胞的寡肽药物转运体（PEPT1）是介导药物吸收的摄取性转运体。PEPT1典型的底物为二肽、三肽类药物，如抗肿瘤药乌苯美司（二肽）。由于β-内酰胺类抗生素、血管紧张素转化酶抑制剂（ACEI）、伐昔洛韦等药物有类似于二肽的化学结构，因此上述药物也是PEPT1的底物。